内伤头痛的主要病位在
A. 肝、脾、胃
B. 肝、心、脾
C. 肝、脾、肾
D. 心、肝、肾
E. 胆、肝、脾

正确答案：C。肝、脾、肾

解析：肝主疏泄，性喜条达。头痛因于肝者，或因肝失疏泄，气郁化火，阳亢火升，上扰头窍而致；或因肝肾阴虚，肝阳偏亢而致。肾主骨生髓，脑为髓海。头痛因于肾者，多因房劳过度，或禀赋不足，使肾精久亏，无以生髓，髓海空虚，发为头痛。脾为后天之本，气血生化之源，头窍有赖于精微物质的滋养。头痛因于脾者，或因脾虚化源不足，气血亏虚，清阳不升，头窍失养而致头痛；或因脾失健运，痰浊内生，阻塞气机，浊阴不降，清窍被蒙而致头痛。故内伤头痛得病位在肝、脾、肾。（C对ABDE错）。